由节后纤维形成
A. 内脏大神经
B. 内脏小神经
C. 盆内脏神经
D. 灰交通支
E. 白交通支

正确答案：D。灰交通支

解析：内脏大、小神经（AB错）由节前纤维构成。盆内脏神经（C错）由骶神经组成。白交通支（E错）由发自脊神经进入交感干的有髓神经纤维构成。交通支为发自交感干的无髓神经纤维，由起于交感干的节后神经纤维构成（D对）。